复位后不需要固定的是
A. 桡骨小头半脱位
B. 孟氏骨折
C. 盖氏骨折
D. colles 骨折
E. 桡骨干骨折

正确答案：A。桡骨小头半脱位

解析：桡骨小头半脱位（A对）桡骨头半脱位多见于5岁以下的儿童，症状大多不严重，不用麻醉可直接手法复位，复位后不用固定，但不可再次暴力牵拉，以免复发。孟氏骨折（B错）盖氏骨折（C错）colles 骨折（D错）桡骨干骨折（E错）复位后均需固定。